参与心底构成的有
A. 左心房和左心室
B. 右心房和右心室
C. 左心房和右心房
D. 左心室和右心室
E. 左、右心房和左、右心室的一部分

正确答案：C。左心房和右心房

解析：左心房和右心房（C对）参与心底构成。心底后面隔心包壁与食管、迷走神经和胸主动脉等相邻。